共同收缩的结果
A. 内直肌、上斜肌
B. 外直肌、上直肌
C. 上直肌、下斜肌
D. 下斜肌、内直肌
E. 外直肌、上斜肌

正确答案：C。上直肌、下斜肌

解析：眼球转向上（仰视），是由于上直肌、下斜肌（C对）共同收缩的结果。